患者，女，32岁，已婚。带下量多，色淡黄，质黏稠，无臭气，面色萎黄，四肢不温，舌淡，苔白腻，脉缓弱。其治法是
A. 清热解毒除湿
B. 清热利湿止带
C. 温肾助阳，涩精止带
D. 滋阴益肾，清热祛湿
E. 健脾益气，升阳除湿

正确答案：E。健脾益气，升阳除湿

解析：该患者带下量多，色淡黄，质黏稠，无臭气，故诊断为带下量多。脾气虚弱，运化失司，湿邪下注，损伤任带，使冲任不固，带脉失约，故带下过多，无臭气。脾虚湿蕴化热，故带下色淡黄，质黏稠，脾虚中阳不振，故面色萎黄，四肢不温。舌淡，苔白腻，脉缓弱均为脾虚湿困之象，故辨为脾虚证。清热解毒除湿带下过多热毒蕴结证的治法（A错）。清热利湿止带为带下过多湿热下注证的治法（B错）。温肾助阳，涩精止带为带下过多肾阳虚证的治法（C错）。滋阴益肾，清热祛湿为带下过多阴虚夹湿证的治法（D错）。健脾益气，升阳除湿为带下过多脾虚证的治法（E对）。